某男，46岁。感冒5日，症见恶寒发热，头痛身楚，胸脘满闷，恶心呕吐，腹痛腹泻。证属外感风寒、内伤食积。治当祛风解表、化湿和中，宜选用的药是
A. 午时茶颗粒
B. 双黄连颗粒
C. 感冒清热颗粒
D. 九味羌活丸
E. 桑菊感冒颗粒

正确答案：A。午时茶颗粒

解析：本题考查的是午时茶颗粒的功能。感冒5日，症见恶寒发热，头痛身楚，胸脘满闷，恶心呕吐，腹痛腹泻。证属外感风寒、内伤食积。治当祛风解表、化湿和中，宜选用的药是午时茶颗粒（A对）。午时茶颗粒：【功能】祛风解表，化湿和中。双黄连颗粒（B错）：【功能】疏风解表，清热解毒。感冒清热颗粒（C错）：【功能】疏风散寒，解表清热。九味羌活丸（D错）：【功能】疏风解表，散寒除湿。桑菊感冒颗粒（E错）：【功能】疏风清热，宣肺止咳。